牙齿发育时期在牙周膜中上皮根鞘残留下来的小的细胞条索称为
A. 成纤维细胞
B. 牙周膜干细胞
C. 成牙骨质细胞
D. Malassez上皮剩余
E. 成骨细胞

正确答案：D。Malassez上皮剩余

解析：上皮剩余：又称Malassez上皮剩余。这是牙根发育期间上皮根鞘残留下来的上皮细胞。镜下为邻近牙根表面的牙周膜纤维间隙中小的上皮条索或上皮团。掌握“牙周膜”知识点。